小学生4年级以下每天自由活动时间应为
A. 1～1.5小时
B. 1.5～2小时
C. 2～2.5小时
D. 2.5～3小时
E. 3～3.5小时

正确答案：A。1～1.5小时